《中华人民共和国刑法》规定销售明知是不符合保障人体健康的国家标准、行业标准的医疗器械、医用卫生材料，对人体健康造成严重危害
A. 处十年以上有期徒刑、无期徒刑或死刑，并处以罚金或没收财产
B. 处七年以上有期徒刑或者无期徒刑，并处以罚金或没收财产
C. 处七年以下有期徒刑，并处以罚金
D. 处三年以上十年以下有期徒刑，并处以罚金
E. 处五年以下有期徒刑，并处以罚金

正确答案：D。处三年以上十年以下有期徒刑，并处以罚金

解析：本题考查生产、销售伪劣商品罪。《中华人民共和国刑法》规定销售明知是不符合保障人体健康的国家标准、行业标准的医疗器械、医用卫生材料，对人体健康造成严重危害处三年以上十年以下有期徒刑，并处以罚金（D对）。《中华人民共和国刑法》第一百四十五条：生产不符合保障人体健康的国家标准、行业标准的医疗器械、医用卫生材料，或者销售明知是不符合保障人体健康的国家标准、行业标准的医疗器械、医用卫生材料，足以严重危害人体健康的，处三年以下有期徒刑或者拘役，并处销售金额百分之五十以上二倍以下罚金；对人体健康造成严重危害的，处三年以上十年以下有期徒刑，并处罚金；后果特别严重的，处十年以上有期徒刑或者无期徒刑，并处罚金或者没收财产。